新生儿预防淋病奈瑟菌所致脓漏眼的常用消毒剂是
A. 2%～4%甲紫
B. 0.1%高锰酸钾
C. 2%红汞
D. 1%硝酸银
E. 2%碘伏

正确答案：D。1%硝酸银